测验取样的平均值，即正常的或平均的成绩，称为
A. 常模
B. 效度
C. 信度
D. 误差
E. 概率

正确答案：A。常模

解析：常模是测验取样的平均值，即正常的或平均的成绩。掌握“信度、效度和常模”知识点。